医务人员在诊疗过程中始终以患者为中心，并把患者的利益放在首位属于
A. 患者至上原则
B. 最优化原则
C. 知情同意原则
D. 保密守信原则
E. 互助协同原则

正确答案：A。患者至上原则

解析：患者至上原则是指医务人员在诊疗过程中始终以患者为中心，并把患者的利益放在首位。掌握“临床诊疗和临床诊断的伦理”知识点。